躯干、四肢痛温觉传导通路
A. 第1级神经元位于脊髓后角
B. 在脊髓水平交叉
C. 于脑桥核中继
D. 最后一神经元于丘脑腹后外侧核
E. 经内囊膝部投射至大脑皮层

正确答案：D。最后一神经元于丘脑腹后外侧核

解析：躯干、四肢痛温觉传导路由3级神经元组成：第1级神经元为脊神经节内假单极神经元（A错）。第2级神经元胞体发出纤维上升1-2个节段经脊髓白质前连合交叉到对侧的外侧索和前索内上行，在延髓水平交叉（B错），组成脊髓丘脑侧束和脊髓丘脑前束（侧束传导痛温觉，前束传导粗略触觉和压觉），最后终止于背侧丘脑腹后外侧核（D对）。第3级神经元最后经内囊后肢投射到中央后回中、上部和中央旁小叶后部（E错）。